必需微量元素的主要生物学效应不包括下列哪项
A. 参与酶的构成和酶的激活
B. 参与某些蛋白质的合成，发挥特殊功能
C. 参与激素及其辅助因子的合成，与内分泌活动密切相关
D. 维持正常的生殖功能
E. 参与体内维生素的合成

正确答案：E。参与体内维生素的合成

解析：本题考查必需微量元素的生物学效应。必需微量元素的生物学效应主要包括：①参与酶的构成和酶的激活，影响酶的活性（A对）；②参与某些蛋白质的合成，发挥特殊功能（B对）；③参与激素及其辅助因子的合成，与内分泌活动密切相关（C对）；④维持正常的生殖功能（D对）。参与体内维生素的合成（E错，为本题正确答案）不是必需微量元素的主要生物学效应。